ALT活性最高的组织是
A. 心肌
B. 脑
C. 骨骼肌
D. 肝
E. 肾

正确答案：D。肝

解析：最重要的转氨酶是谷丙转氨酶（GPT）又称丙氨酸转氨酶（ALT），及谷草转氨酶（GOT）又称天冬氨酸转氨酶（AST）。肝中ALT活性最高，AST在心肌和肝中活性都很高。掌握“氨基酸及氨的代谢”知识点。